医疗机构配制制剂，应是本单位临床需要而市场上没有供应的品种，并须经所在地下列哪个部门批准后方可配制
A. 省级卫生行政部门
B. 县级卫生行政部门
C. 省级药品监督管理部门
D. 地市级药品监督管理部门
E. 省级工商行政管理部门

正确答案：C。省级药品监督管理部门

解析：《药品管理法》规定，医疗机构配制制剂应当是本单位临床需要而市场上没有供应的品种，并须经所在地省级药品监督管理部门（C对）批准后方可配制。